面颊部是上颌突与下列哪个突起由后向前联合所致
A. 额鼻突
B. 中鼻突
C. 侧鼻突
D. 球状突
E. 下颌突

正确答案：E。下颌突

解析：上颌突与下颌突由后向前联合，形成面颊部，同时使口凹缩小至正常口裂的大小。掌握“面部的发育”知识点。